治湿热泻痢、痔疮肿痛，宜选用
A. 青蒿
B. 白薇
C. 地骨皮
D. 银柴胡
E. 胡黄连

正确答案：E。胡黄连

解析：本题考查的是胡黄连的主治病证。治湿热泻痢、痔疮肿痛，宜选用胡黄连（E对）。胡黄连：【主治病证】（1）骨蒸潮热。（2）小儿疳热。（3）湿热泻痢，黄疸。（4）咽痛，疮肿，痔肿便血。青蒿（A错）：【主治病证】（1）阴虚发热，骨蒸潮热，虚热兼表。（2）热病后期之夜热早凉，或低热不退。（3）血热疹痒、吐血、衄血。（4）疟疾寒热。（5）暑热外感，暑热烦渴。白薇（B错）：【主治病证】（1）阴虚发热，骨蒸潮热，产后虚热，阴虚外感。（2）温病热入营血证，肺热咳嗽。（3）热淋，血淋。（4）痈肿疮毒，咽喉肿痛，毒蛇咬伤。地骨皮（C错）：【主治病证】（1）阴虚发热，有汗骨蒸，小儿疳热。（2）血热之吐血、衄血、尿血。（3）肺热咳嗽。（4）内热消渴。银柴胡（D错）：【主治病证】（1）阴虚发热，骨蒸劳热。（2）小儿疳热。